慢性肾小球肾炎患者理想的血压控制目标为
A. 130/80mmHg以下
B. 130/80mmHg以上
C. 140/90mmHg以下
D. 140/90mmHg以上
E. 160/100mmHg以下

正确答案：A。130/80mmHg以下

解析：理想的血压控制目标为130/80mmHg以下（若尿蛋白大于1g/d，应更低）。掌握“慢性肾小球肾炎、肾病综合征”知识点。